有关肩胛骨的描述何者是错误的
A. 为三角形扁骨
B. 后面由肩胛冈分成冈上窝和冈下窝
C. 下角平对第7肋（或第7肋间隙）
D. 喙突的外侧有肩胛切迹
E. 上角平对第2肋上缘

正确答案：D。喙突的外侧有肩胛切迹

解析：肩胛骨为三角形扁骨（A对），背侧面的横嵴称肩胛冈，冈上、下方的窝，分别称冈上窝和冈下窝（B对）。肩胛上角为上缘与脊柱缘会合处，平对第2 肋（E对） ，下角为脊柱缘与腋缘会合处，平对第 7 肋或第 7 肋间隙（C对）。肩胛上缘短而薄，外侧份有肩胛切迹，更外侧有向前的指状突起称喙突（D错，为本题正确答案）。